男，54岁。肛门胀痛6天，为持续性痛，逐渐加重，排便和行走时出现剧痛，有里急后重感和排便困难，伴发热，全身不适。查体：T39.6℃，肛门左侧红肿，有明显压痛。肛诊：直肠左侧饱满，压痛（+），有波动感。实验室检查WBC21×10⁹/L，N0.92。决定立即行切开引流术，最主要的依据是
A. 白细胞增高
B. 局部饱满有波动感
C. 有排便困难
D. 高热，全身症状
E. 行走时出现疼痛

正确答案：B。局部饱满有波动感

解析：患者肛门部位红、痛、热、痛（局部炎症），伴有直肠刺激征，发热、全身不适、白细胞高（全身中毒症状），应诊断为坐骨肛管间隙脓肿。直肠左侧饱满有波动感（B对）、压痛（+），说明局部脓肿已形成，应施行切口引流术。白细胞增高（A错）、高热，全身症状（D错）仅代表感染。有排便困难（C错）、行走时出现剧痛（E错）仅代表局部炎症反应明显，而行切口引流的主要依据是脓肿形成。